不含毒性成分马兜铃酸的药材是
A. 关木通
B. 广防己
C. 青木香
D. 千里光
E. 天仙藤

正确答案：D。千里光

解析：本题考查的是含有肾毒性成分马兜铃酸的药材。不含毒性成分马兜铃酸的药材是千里光（D错，为本题正确答案）。肾毒性成分的马兜铃酸，主要存在于马兜铃科马兜铃属的关木通（A对）、广防己（B对）、青木香（C对）、马兜铃、天仙藤（E对）、朱砂莲等药材中。